在进行乳腺癌病因的病例对照研究时，最理想的病例是
A. 一个地区肿瘤发病监测系统登记的所有乳腺癌病人
B. 一个地区多所医院新诊断的乳腺癌病人
C. 一所肿瘤专科医院收治的所有乳腺癌病人
D. 一个地区肿瘤死亡监测系统登记的所有乳腺癌病人
E. 一个地区多所医院诊断的所有乳腺癌病人

正确答案：A。一个地区肿瘤发病监测系统登记的所有乳腺癌病人

解析：选择病例时最好选择新发病例，新发病例由于刚刚发病，对疾病危险因素的回忆可能比较认真而且清楚，提供的信息较为可靠；病例的来源以社区人群来源为优，代表性强。掌握“流行病学概论”知识点。